断裂的上皮根鞘如果遗留在牙周膜中，称为
A. Serre上皮剩余
B. 马拉瑟上皮剩余
C. 上皮隔
D. 结合上皮
E. 釉小皮

正确答案：B。马拉瑟上皮剩余

解析：牙本质形成后，断裂的上皮根鞘大部分被吸收，部分可遗留在发育中的牙周膜中，称上皮剩余，也称马拉瑟上皮剩余。掌握“牙体、牙周组织的形成”知识点。